疫疠邪气的致病特点有
A. 发病急
B. 病情重
C. 症状相似
D. 传染性强
E. 易于流行

正确答案：A、B、C、D、E。发病急；病情重；症状相似；传染性强；易于流行

解析：本题考查的是疠气的致病特点。疫疠邪气的致病特点有发病急（A对）、病情重（B对）、症状相似（C对）、传染性强（D对）与易于流行（E对）。疠气，即疫疠邪气，是一类具有强烈传染性的外感致病邪气，又称“戾气”“异气”“毒气”“乖戾之气”等。疠气与一般的六淫邪气不同，乃是天地间别有的一种特殊的致病因素。疠气致病，多从口鼻侵入人体。在人群中，可以散在发生，也可以形成瘟疫大面积流行。疫疠邪气所致疾病称“疫病”，如大头瘟、疫痢、白喉、烂喉丹痧、天花、霍乱、鼠疫等。疠气的致病特点：发病急骤、病情较重；一气一病、症状相似；传染性强、易于流行。